慢性淋巴性甲状腺炎引起原发性甲状腺功能减退症替代治疗的原则
A. 由大剂量开始，逐渐递减到合适剂量
B. 从小剂量开始，逐渐递增到合适剂量
C. 甲减越严重，起始剂量应越大
D. 间断用药有利于预防心绞痛
E. 待甲状腺功能正常后可停用

正确答案：B。从小剂量开始，逐渐递增到合适剂量

解析：原发性甲减的治疗常以左甲状腺素作替代治疗，一般初始剂量小，为25～50μg/d，每1～2周增加25μg，逐渐递增到合适剂量（B对AC错）。患缺血性心脏病者起始剂量宜小，调整剂量宜慢，防止诱发和加重心脏病（D错）。无论何种原因导致的甲减，除药物引起的暂时性甲减外，其他永久性甲减均需终生服药，而非待甲状腺功能正常后可停用（E错）。